下列哪项不是足厥阴肝经的循行
A. 起于大趾丛毛之际
B. 上循足跗上廉，去内踝一寸
C. 循喉咙之后，上入颃颡
D. 循股阴，入毛中，环阴器
E. 上腘内廉，上股内后廉

正确答案：E。上腘内廉，上股内后廉

解析：该题考查足厥阴肝经的循行。足肝足厥阴之脉，起于大指丛毛之际（A错），上循足跗上廉（B错），去内踝一寸，上踝八寸，交出太阴之后，上腘内廉，循股阴，入毛中，环阴器（D错），抵小腹，挟胃，属肝，络胆，上贯膈，布胁肋，循喉咙之后（C错），上入颃颡，连目系，上出额，与督脉会于巅。其支者；从目系下颊里，环唇内。其支者：复从肝别贯膈注肺（E对）。